为了预防大骨节病，应增加膳食中哪种谷物的比例
A. 小麦
B. 玉米
C. 大米
D. 高梁
E. 小米

正确答案：C。大米

解析：本题考查大骨节病的预防。大骨节病是一种地方性、慢性骨关节变形性疾病，以四肢关节软骨和骺板软骨变性坏死、增生、修复为主要病理改变，以骨关节增粗、畸形、强直、肌肉萎缩、运动障碍为主要临床表现。为了预防大骨节病，应增加膳食中大米（C对ABDE错）的比例。若大米在主食中比例增加至30%以上，可使大骨节病发病率明显下降；若大米比例达到80%以上，基本可以控制大骨节病的流行。